女，32岁。间断喘息5年，无明显规律，发作间期无不适，此次因“气喘6小时”来院。查体：T36.8℃，端坐呼吸，口唇发绀，双肺呼吸音低，呼气相明显延长，未闻及哮鸣音。血常规：WBC8.3×10⁹/L，N0.75。该患最可能的诊断是
A. 慢性支气管炎
B. 支气管哮喘
C. 心源性哮喘
D. 过敏性肺炎
E. 肺栓塞

正确答案：B。支气管哮喘

解析：中年女性患者，有发作性喘息病史，考虑为支气管哮喘。此次病情加重来院，双肺呼吸音低，呼气相明显延长，双肺未闻及哮鸣音（表现为“沉默肺”，为病情加重的表现），考虑为支气管哮喘（B对）。慢性支气管炎（P20）（A错）缓慢起病，病程长，表现为反复的咳嗽、咳痰或伴有喘息，该患者没有明显的咳嗽咳痰症状，故不是最可能的诊断。心源性哮喘（C错）多见于器质性心脏病患者，发作时必须坐起，重症者肺部有干、湿啰音，甚至咳粉红色泡沫痰。过敏性肺炎（D错）是易感人群反复吸入各种具有抗原性的有机粉尘、低分子量化学物质引起的一组弥漫性间质性肉芽肿性肺病，表现为发热、干咳、呼吸急促、胸痛及缺氧、口唇、指趾末端发绀等，发作时肺部体征与哮喘发作时不同，多无哮鸣音，主要听到的是湿性啰音。肺栓塞（P100）（E错）主要表现为突然发生的呼吸困难、剧烈胸痛、发热、咯血等。